患者因高血压同时服用厄贝沙坦和缬沙坦,属于
A. 有用药禁忌
B. 无适应证用药
C. 重复用药
D. 无明确指征联合用药
E. 无正当理由超说明书用药

正确答案：D。无明确指征联合用药

解析：本题考查无明确指征联合用药。厄贝沙坦和缬沙坦属同类药物联合使用，属于无明确指征联合用药（D对）。有用药禁忌（A错）表现在：忽略药品说明书的提示；忽略病情和患者的基础疾病。无适应证用药（B错）是临床上无明显细菌感染指征，但常被给予抗菌药物。重复用药（C错）是在一定的时间内，反复使用同一药物，以维持体内的有效浓度，使药物持续发挥作用。无正当理由超说明书用药（E错）是指药品使用的适应证、剂量、疗程、途径或人群等未在药品监督管理部门批准的药品说明书记载范围内的用法。